关于药品标准制定原则的说法，正确的是
A. 坚持质量第一，体现“安全有效、科学严谨、技术可行、经济合理”的原则，全面与国际标准接轨，起到促进质量提高的作用
B. 根据“准确、灵敏、简便、迅速”的原则，选择并规定检测、检验方法，既要考虑现阶段的实际水平和条件，又要体现新技术的应用和发展
C. 标准规定的各种限量应当结合实践，要保证新药在研制、生产、经营和使用环节的质量安全
D. 充分考虑研制、生产、经营和使用各环节对药品质量的影响因素，全面制定检测项目，加强对药品内在质量的控制

正确答案：B。根据“准确、灵敏、简便、迅速”的原则，选择并规定检测、检验方法，既要考虑现阶段的实际水平和条件，又要体现新技术的应用和发展

解析：本题考查的是药品标准的制定原则。关于药品标准制定原则的说法，正确的是根据“准确、灵敏、简便、迅速”的原则，选择并规定检测、检验方法，既要考虑现阶段实际水平和条件，又要体现新技术的应用和发展（B对）。药品标准的制定原则包括以下内容：1.坚持质量第一，体现“安全有效、技术先进、科学严谨、经济合理”的原则，尽可能与国际标准接轨，起到促进质量提高，择优发展的作用（A错）。2.充分考虑生产、流通、使用各环节对药品质量的影响因素，有针对性地制定检测项目，切实加强对药品内在质量的控制（D错）。3.根据“准确、灵敏、简便、迅速”的原则选择并规定检测、检验方法，既要考虑现阶段的实际水平和条件，又要体现新技术的应用和发展。4.标准规定的各种限量应结合实践，要保证药品在生产、储运、销售和使用过程中的质量（C错）。